牙周炎的伴发病变包括
A. 牙周脓肿
B. 根分叉病变
C. 牙龈退缩
D. 根面龋
E. 以上均是

正确答案：E。以上均是

解析：本题考查牙周炎的伴发病变。牙周脓肿（A对）、根分叉病变（B对）、牙龈退缩（C对）、根面龋（D对）均为牙周病的伴发病变（ABCD均对，故E对为本题的正确答案）。此外还有牙周-牙髓联合病变和呼气异味。